患者，男，48岁。大便出血，色鲜红，血量不等，有赘物垂于肛外。治疗应首选
A. 承山
B. 大肠俞
C. 小肠俞
D. 隔俞
E. 血海

正确答案：A。承山

解析：大便出血，并且有赘物垂于肛门外，可诊断为痔疮。治疗时根据"经脉所过主治所及"的道理，循经远道取膀胱经的承山穴，因膀胱经脉循行的后项支脉与腰部下来的支脉会合于腘窝中，从此向下通过腓肠肌。承山穴是膀胱经腧穴而且位于腓肌，两肌腹之间，主治痔疮（A对）。大肠俞、小肠俞、膈俞、血海虽可以治疗血证但不是治疗痔疾的最佳选择（BCDE错）